可用于苯巴比妥的鉴别方法有
A. 加硝酸铅试液，生成白色沉淀
B. 加铜吡啶试液，生成紫色沉淀
C. 加硫酸与亚硝酸钠，混合，即显橙黄色
D. 加碘试液，可使碘试液褪色
E. 加碳酸钠试液成碱性，加硝酸银试液，产生白色沉淀

正确答案：B、C、E。加铜吡啶试液，生成紫色沉淀；加硫酸与亚硝酸钠，混合，即显橙黄色；加碳酸钠试液成碱性，加硝酸银试液，产生白色沉淀

解析：本题考查常用的药品鉴别方法。可用于苯巴比妥的鉴别方法有加铜吡啶试液，生成紫色沉淀（B对）；加硫酸与亚硝酸钠，混合，即显橙黄色（C对）；加碳酸钠试液成碱性，加硝酸银试液，产生白色沉淀（E对）。巴比妥类药物分子中含有丙二酰脲结构，在吡啶溶液中生成稀醇式异构体与铜离子吡啶溶液反应生成紫色配位化合物。巴比妥类药物分子中含有丙二酰脲结构，在碱性条件下可以发生烯醇式互变，加入硝酸银试液即生成白色沉淀，振摇，沉淀即溶解，继续滴加过量的硝酸银试液，沉淀不再溶解。苯巴比妥分子中具有芳环取代基，可与硫酸-亚硝酸钠反应，反应生成橙黄色产物，并随即变成橙红色。硫喷妥钠中含有硫元素，在氢氧化钠溶液中与铅离子反应生成白色沉淀（A错）。司可巴比妥钠分子中具有不饱和的双键，可与碘发生加成反应，而使碘溶液的棕黄色褪去（D错）。